腭帆
A. 是软腭的前部
B. 前缘游离
C. 吸气时上升
D. 吞咽时下降
E. 以上都不对

正确答案：E。以上都不对

解析：腭帆为软腭的后部(A错)，腭帆后缘游离(B错)，呼气时和吞咽时上提(CD错，故E为本题正确答案)。